疫苗预防接种效果评价的双盲试验是指
A. 观察者和受试者均不知道实验组和对照组各为何人
B. 观察者不知道实验组和对照组各为何人
C. 观察者和资料分析者知道实验组和对照组各为何人
D. 试验组采用疫苗，而对照组采用安慰剂的试验方法
E. 观察者和受试者均不知道如何评价预防效果

正确答案：A。观察者和受试者均不知道实验组和对照组各为何人